《黄帝内经》以后的中医学理论，继承并发展了阴阳学说，建立了阴阳五行病理学说及外因“六淫”（风、寒、暑、湿、燥、火）、内因“七情”（喜、怒、忧、思、悲、恐、惊）等病因学说，这一学说属于
A. 神灵主义医学模式
B. 生物医学模式
C. 机械医学模式
D. 自然哲学医学模式
E. 生物心理社会医学模式

正确答案：D。自然哲学医学模式

解析：本题考查自然哲学医学模式。《黄帝内经》以后的中医学理论，继承并发展了阴阳学说，建立了阴阳五行病理学说及外因“六淫”（风、寒、暑、湿、燥、火）、内因“七情”（喜、怒、忧、思、悲、恐、惊）等病因学说，这一学说属于自然哲学医学模式（D对ABCE错）。